男，35岁。镜下血尿伴蛋白尿3年。辅助检查：尿RBC20～25/HP，为异形红细胞，尿蛋白定量1.5g/d，血肌酐90μmol/L。B超示双肾大小正常。为明确诊断需要进一步采取的检查是
A. 肾活检
B. 尿培养
C. 肾盂造影
D. ANCA
E. 腹部X线平片

正确答案：A。肾活检

解析：中年男性患者，镜下血尿伴蛋白尿3年（＞3个月，提示有慢性肾脏病），辅助检查尿RBC20～25/HP（正常值0～3个/HP，提示有血尿），为异形红细胞（肾小球源性血尿），尿蛋白定量1.5g/d（正常值≤0.15g/d，提示有蛋白尿），血肌酐90μmol/L（正常值44～133μmol/L），B超示双肾大小正常。根据患者的病史、临床表现、实验室检查，考虑诊断为慢性肾小球肾炎，为明确诊断需要进一步采取的检查是肾活检（A对）。肾穿刺活检可以直接观察病变肾脏的形态学改变，并能明确肾小球疾病的病因、病理类型、发展趋势等。尿培养（B错）主要用于尿路感染的诊断。肾盂造影（C错）多用于肾盂肾炎的诊断。ANCA（抗中性粒细胞胞质抗体）（D错）阳性主要见于原发性小血管炎患者（P467）。腹部X线平片（E错）主要用于消化道穿孔、肠梗阻及腹腔钙化或结石的诊断。